患儿发热，随后出现呕吐和意识障碍。应首先考虑的是
A. 病毒性脑炎
B. 尿毒症
C. 癫痫
D. 有机磷农药中毒
E. 先天性心脏病

正确答案：A。病毒性脑炎

解析：患儿发热，随后出现呕吐和意识障碍。应首先考虑的是病毒性脑炎（A对），病毒性脑炎患儿在弥漫性大脑病变的基础上主要表现为发热、反复惊厥发作、不同程度的意识障碍及颅内压增高表现。尿毒症（P526）（B错）即肾功能衰竭综合征，主要表现为食欲消失、感觉迟钝、情感淡漠、嗜睡、尿量减少、颜面和下肢水肿、贫血等症状。癫痫（C错）主要表现为突然的意识丧失，继而出现强直，后发生阵挛性痉挛，常伴尖叫，面色青紫，尿失禁，舌咬伤，口吐白沫或血沫，瞳孔散大，持续数十秒或数分钟后痉挛发作自然停止，进入昏睡状态，醒后有短时间的头昏，烦躁，疲乏，对发作过程不能回忆，若发作持续不断，常危及生命。有机磷农药中毒（P883）（D错）主要表现为恶心、呕吐、腹痛、多汗、腹泻、尿频、大小便失禁、心跳减慢和瞳孔缩小等症状。先天性心脏病（P285）（E错）轻者无症状，重者可有活动后呼吸困难、紫绀、晕厥等，年长儿可有生长发育迟缓。